—名45岁的男性，由于患肺结核病而就诊，经问诊得知他已经吸烟20年，每天吸一包烟。他表示考虑在未来一个月内戒烟，作为一名临床医生，你要做的是
A. 强调戒烟的好处
B. 和病人一起确定戒烟日期
C. 提供戒烟药物
D. 随访
E. 告知吸烟的危害

正确答案：D。随访

解析：该患者45岁，吸烟20年，每天一包，今因肺结核来院就诊，由于肺结核具有病程较长、易复发和具有传染性等特点，必须要长期随访（D对），掌握患者从发病、治疗到治愈的全过程。通过对确诊肺结核病例的登记达到掌握疫情和便于管理的目的。